李某，自费学医后自行开业，因违反诊疗护理常规致使患者死亡，追究其刑事责任的机关是
A. 卫生行政部门
B. 工商行政部门
C. 医疗事故鉴定委员会
D. 管辖地人民政府
E. 管辖地人民法院

正确答案：E。管辖地人民法院

解析：李某，自费学医，自行开业，其无行医资格，属于非法行医，且因违反诊疗护理常规致使患者死亡，李某需承担刑事责任，故追究其刑事责任的机关是管辖地人民法院（E对）。卫生行政部门（A错）、工商行政部门（B错）、医疗事故鉴定委员会（C错）、管辖地人民政府（D错）均为行政机关，只能行使行政处罚权利。